有关安瓿处理的错误表述是
A. 小量生产时，新鲜的注射用水洗净后，可直接灌装药液
B. 大量生产时，洗净的安瓿应用120～140℃干燥
C. 无菌操作需用的安瓿，可在电热红外线隧道式烘箱中处理，平均温度200℃
D. 为了避免微粒污染，可配备局部层流洁净装置，使已洗净的安瓿保持洁净
E. 未灭菌的安瓿应在24h内使用

正确答案：D。为了避免微粒污染，可配备局部层流洁净装置，使已洗净的安瓿保持洁净